某男性，年龄25岁，工龄2年，某矿场的采石工。因主诉咳嗽、胸痛、气短等症状就诊。患者自述，采矿场工作条件很差，无防尘措施。X线胸片呈肺纹理增加，伴有块状阴影和典型结节。诊断时应注意哪种尘肺
A. 煤肺
B. 矽肺
C. 石棉肺
D. 尘肺
E. 煤矽肺

正确答案：B。矽肺

解析：本题考查矽肺的诊断。矽肺（B对ACDE错）病人随着病情的进展，可出现胸闷、气短、胸痛、咳嗽、咳痰等症状和体征。X线胸片可呈毛玻璃状和（或）网状及斑片状阴影，可为对称或不对称性，有时可见支气管充气征。